外侧膝状体属于皮质下中枢
A. 深感觉
B. 痛温觉
C. 自主神经
D. 听觉
E. 视觉

正确答案：E。视觉

解析：第1视区位于距状沟上、下方的枕叶皮质，即上方的楔叶和下方的舌回(17区），接受来自外侧膝状体的纤维，所以外侧膝状体属于皮质下视觉（E对）中枢。